尿毒症病人高血压最主要的原因是
A. 肾素增多
B. 促红素减少
C. 水钠潴留
D. 血管加压素增多
E. 交感神经兴奋

正确答案：C。水钠潴留

解析：尿毒症病人常伴有高血压，持续存在的高血压会加速肾功能进一步恶化。尿毒症病人形成高血压的原因主要有：①水、钠潴留（C对）：血容量增加引起容量依赖性高血压，为尿毒症病人形成高血压最主要的原因；②肾实质缺血刺激肾素-血管紧张素分泌增加（A错），小动脉收缩，外周阻力增加，引起肾素依赖性高血压，为尿毒症病人形成高血压的次要原因；③肾实质损害后肾内降压物质分泌减少，如激肽释放酶-激肽、前列腺素等，是尿毒症病人形成高血压的原因之一；④交感神经兴奋（E错）可以引起心脏正性肌力作用（心率加快、心肌收缩力增加、心排血量增加）导致血压升高，是尿毒症病人形成高血压的原因之一。促红素主要由肾间质细胞产生，可以促进红细胞生成，促红素减少（B错）主要引起肾性贫血（P527）。血管加压素（VP）（D错）又称抗利尿激素（ADH），其有效刺激为血浆晶体渗透压升高，血量减少，血压降低，主要作用为提高远曲小管和集合管对水通透性，促进水的重吸收，尿毒症患者水、钠潴留，血浆晶体渗透压降低，血管加压素减少。